患者，女，24岁，一周前曾有同事患有沙眼，系衣原体感染，后发现自己也出现眼红、眼痒等不适，来药店购药，药师可推荐的药物是
A. 色甘酸钠滴眼液
B. 玻璃酸钠滴眼液
C. 酞丁安滴眼液
D. 毛果芸香碱滴眼液
E. 吡诺克辛滴眼液

正确答案：C。酞丁安滴眼液

解析：本题考查沙眼用药。患者，女，24岁，一周前曾有同事患有沙眼，系衣原体感染，后发现自己也出现眼红、眼痒等不适，来药店购药，药师可推荐的药物是酞丁安（C对）。酞丁安具有较强的抑制沙眼衣原体的作用，对沙眼有很好的疗效。色甘酸钠滴眼液（A错）可用于治疗过敏性结膜炎和春季卡他性结膜炎。玻璃酸钠滴眼液（B错）可改善眼部干燥症状。毛果芸香碱滴眼液（D错）可用于治疗青光眼。吡诺克辛滴眼液（E错）可用于治疗初期老年性白内障。